病例对照研究中，能较好地回忆和确定病因因素的病例应首选
A. 现患病例
B. 新发病例
C. 死亡病例
D. 重病例
E. 轻病例

正确答案：B。新发病例

解析：本题考查病例对照研究新发病例的优点。在病例对照研究中，首选的病例类型是新发病例（B对ACDE错），其优点在于：①新发病例包括不同病情和预后的病人，代表性好；②病人确诊不久即被调查，对有关暴露的回忆信息较为准确可靠，不受各种预后因素的影响；③病历资料容易获得。